女，23岁。与路人争吵后四肢发抖，继而倒地不能行走，遂送往医院检查，未发现器质性病变。该患者首选的治疗是
A. 暗示治疗
B. 抗抑郁治疗
C. 对症治疗
D. 镇静催眠治疗
E. 鼓励疏泄

正确答案：A。暗示治疗

解析：该患者与路人争吵后四肢发抖，继而倒地不能行走，未发现器质性病变，故诊断为分离（转换）性障碍，首选治疗为暗示治疗（A对）。若伴有抑郁时可给予相应的抗抑郁药，而本例无抑郁症状（情感低落），故抗抑郁治疗不作首选（B错）。镇静催眠治疗可能有效，有时静注异戊巴比妥或口服劳拉西泮对催眠有帮助，催眠有助于恢复失去的记忆，重新获得有关身份的资料，帮助患者回忆分离的回忆，不作为首选治疗（D错）。